男性，25岁。间断左耳流脓5个月，两个月来左外耳道干燥。近一个月来出现持续性头痛，体温38℃左右。入院前两周头痛加重，伴呕吐。三小时前呼之不应，急诊入院。入院查体，中度昏迷，瞳孔左：右＝4：2，对光反应消失，右侧肢体力弱，以上肢为著，右侧霍夫曼氏征（+）。最可能的临床诊断为
A. 自发性颅内出血
B. 脑栓塞
C. 脑脓肿继发脑疝
D. 脑肿瘤
E. 急性梗阻性脑积水

正确答案：C。脑脓肿继发脑疝

解析：青年患者，间断左耳流脓5个月，两个月来左外耳道干燥（提示患者有慢性中耳炎），近一个月来出现持续性头痛，体温38℃左右，入院前两周头痛加重，伴呕吐，提示患者有明显的颅内压增高症状，且已经表现出呼之不应、中度昏迷，左侧瞳孔散大，对光反应消失（左侧动眼神经麻痹），右侧肢体力弱，上肢为著，右侧霍夫曼氏征（+）等脑干受压的症状。根据病史诊断为耳源性脑脓肿继发脑疝（C对）。自发性颅内出血（A错）、脑肿瘤（D错）多见于中老年人，青年人少见，且一般无发热等感染症状。脑栓塞（B错）多在活动中急骤起病，无前驱症状，多变现为完全性卒中（P185）。 急性梗阻性脑积水（E错）急性起病，不会出现长达一个月的持续性头痛。